抑制CDP还原成dCDP的药物是
A. 8氮杂鸟嘌呤
B. 甲氨蝶呤
C. 阿糖胞苷
D. 5-氟尿嘧啶
E. 别嘌呤醇

正确答案：C。阿糖胞苷